上颌骨骨折首选的X线投照位置是
A. 颅底位（颏顶位）
B. 华特位（鼻颏位）
C. 柯氏位（鼻额位）
D. 上颌前部咬合片
E. 曲面体层

正确答案：B。华特位（鼻颏位）

解析：本题考查上颌骨骨折首选的X线投照位置。上颌骨骨折首选的X线投照位置是华特位（鼻颏位）（B对）。华特位又称为鼻颏位，主要用于观察上颌窦、额窦、筛窦、眼眶、鼻腔、上颌骨、颧骨、颧弓、下颌喙突在上颌与颧弓之间的位置以及颌间间隙等情况，在上颌骨肿瘤、炎症及外伤时常用此片观察颌面骨的情况。颅底位（颏顶位）（A错）可了解颅底骨质，如破裂孔、卵圆孔、棘孔及翼窦板，也可显示鼻咽腔、上颌窦后壁、蝶窦情况，适用于颅底先天性疾病，颅底骨炎症、肿瘤及肿瘤样病变，颅内疾病所致颅底病变，内听道、鼻旁窦、颧骨等病变。柯氏位（鼻额位）（C错）可了解窦腔的发育情况、形状、大小，有无粘膜增厚，占位性病变及骨壁破坏等，主要用以检查额窦和筛窦，也可显示上颌窦、鼻腔和眼眶。上颌前部咬合片（D错）可显示上颌前部全貌，包括切牙孔、鼻中隔、上颌窦、鼻泪管、上颌前牙及腭中缝等结构，常用于观察上颌前部骨质变化及乳、恒牙的情况。曲面体层（E错）可在一张胶片上显示双侧上、下颌骨、上颌窦、颞下颌关节及全口牙齿等，常用于观察上下颌骨肿瘤、外伤、炎症、畸形等病变及其与周围组织的关系。